寒邪伤人，出现脘腹冷痛呕吐等症状的主要原因是
A. 寒性黏滞，气机不畅
B. 寒性收引，经脉拘急
C. 寒性凝滞，气血流行不利
D. 寒性收引，气血凝滞不通
E. 寒邪伤阳，直中脾胃

正确答案：E。寒邪伤阳，直中脾胃

解析：寒为阴邪，易伤阳气。寒邪直中脾胃，脾阳受损，可见脘腹冷痛呕吐（E对）。寒性凝带主痛（C错），湿性黏滞，而非寒性（A错）。寒性收引，指寒邪侵袭人体，可使气机收敛，腠理、经络、筋脉收缩而挛急，如寒邪伤及肌表，卫阳郁遏不得宣泄，毛窍腠理闭塞，可见恶寒，无汗等；寒客血脉，则气血凝滞，血脉挛缩，可见头身疼痛，脉紧；寒客经络关节，则挛急作痛，屈伸不利，或冷厥不仁等（BD错）。